人体生长发育的第一高峰期是
A. 婴儿期
B. 幼儿期
C. 学龄前儿童期
D. 学龄儿童期
E. 青少年期

正确答案：A。婴儿期

解析：本题考查人体生长发育的第一高峰期。人体生长发育的第一高峰期是婴儿期（A对BCDE错）。